药物不良反应
A. 一般都很严重
B. 发生在大剂量情况下
C. 产生原因与药物作用的选择性高有关
D. 可发生在治疗剂量
E. 只是一种过敏反应

正确答案：D。可发生在治疗剂量